防止噪声危害最根本的措施是
A. 制定合理的噪声卫生标准
B. 控制噪声传播和反射
C. 控制和消除噪声源
D. 使用有效的个人防护用品
E. 厂区厂房的合理规划

正确答案：C。控制和消除噪声源

解析：本题考查控制噪声的措施。企业从控制声源、阻断噪声（C对ABDE错）的传播来控制作业场所的噪声强度，这是防止噪声危害的最根本的措施；为噪声作业人员佩戴护耳器，减少个体噪声的暴露水平；健康监护有助于及早发现噪声易感者及噪声聋病人；健康教育有利于提高作业人员的健康保护意识及健康行为；控制噪声传播和反射，也是有效降低噪声的途径。